可以出现多个牙齿松动及下唇麻木的颌骨骨髓炎是
A. 下颌骨中央性骨髓炎
B. 边缘性骨髓炎
C. 新生儿骨髓炎
D. 放射性骨髓炎
E. 慢性硬化性骨髓炎

正确答案：A。下颌骨中央性骨髓炎

解析：下颌骨中央性骨髓炎可沿下牙槽神经管扩散，波及一侧下颌骨，甚至越过中线累及对侧下颌骨；下颌牙部分或全部松动，龈袋溢脓，龈充血水肿。下牙槽神经受到损害时，可出现下唇麻木症状。掌握“颌骨骨髓炎”知识点。